拇主要动脉发自
A. 桡动脉
B. 尺动脉
C. 指掌侧总动脉
D. 掌浅弓
E. 掌深弓

正确答案：A。桡动脉

解析：桡动脉（A对）发出拇主要动脉和掌浅支，前者分布于拇指掌侧面的两侧缘以及示指桡侧缘，后者与尺动脉的末端吻合形成掌浅弓。